“无阴则阳无以化”说明了阴阳之间的何种关系
A. 阴阳交感
B. 阴阳互根
C. 阴阳对立
D. 阴阳消长
E. 阴阳转化

正确答案：B。阴阳互根

解析：阴阳互根的意义，在于阴阳始终处于统一体之中，每一方都以对方的存在作为自身存在的前提和条件，任何一方都不能脱离对方而单独存在（B对）。阴阳交感，指阴阳二气在运动中相互感应而交合的相互作用。阴阳交通相合，彼此交感相错，是宇宙万物赖以生成和变的根源，所谓“天地感而万物化生”（A错）。阴阳转化，指事物的阴阳属性，在一定条件下可以向其相反的方向转化，即属阳的事物可以转化为属阴的事物，属阴的事物可以转化为属阳的事物（E错）。阴阳对立，指阴阳"一分为二"，即对待、相反的关系，是事物或现象固有的属性。阴阳对立制约的意义在于防止阴阳的任何一方不至于亢盛为害，以维持阴阳之间的协调平衡（C对）。阴阳消长，指阴阳双方不是静止不变的，而是处于不断的消减和增加的运动变化之中。消，减少、减退；长，增加、增长（D错）。